下列中毒性细菌性痢疾的治疗措施错误的是
A. 抗菌治疗
B. 扩充血容量
C. 纠正代谢性酸中毒
D. 应用血管活性药物
E. 纠正代谢性碱中毒

正确答案：E。纠正代谢性碱中毒

解析：中毒性菌痢的治疗措施包括：（1）病原治疗：抗菌治疗（A对），采用有效抗生素静脉滴注；（2）对症治疗：①降温止惊；②休克型：扩充血容量（B对），纠正酸中毒（E错，为本题正确答案）（C对），改善微循环障碍，包括在扩充血容量的基础上，应用血管活性药物（D对），效果不佳者可改用多巴胺、酚妥拉明等。